轻粉的功效是
A. 杀虫止血
B. 杀虫截疟
C. 杀虫利水
D. 杀虫止痒
E. 杀虫壮阳

正确答案：C。杀虫利水

解析：本题考查的是轻粉的功效。轻粉的功效是杀虫利水（C对）。轻粉：【功效】外用杀虫、攻毒、敛疮；内服祛痰消积，逐水通便。白矾：【功效】外用解毒杀虫，燥湿止痒；内服止血（A错）止泻，清热消痰。雄黄：【功效】解毒，杀虫，燥湿祛痰，截疟（B错）定惊。蛇床子：【功效】燥湿祛风，杀虫止痒（D错），温肾壮阳（E错）。